上颌神经通过
A. 棘孔
B. 卵圆孔
C. 圆孔
D. 破裂孔
E. 无

正确答案：C。圆孔

解析：上颌神经经海绵窦外侧壁，穿圆孔（C对）出颅，进入翼腭窝上部。